关于酶竞争性抑制剂的叙述错误的是
A. 抑制剂与底物结构相似
B. 抑制剂与底物竞争酶的底物结合部位
C. 增加底物浓度也不能达到最大反应速度
D. 当抑制剂存在时Km值变大
E. 抑制剂与酶非共价结合

正确答案：C。增加底物浓度也不能达到最大反应速度

解析：酶竞争性抑制剂与底物结构相似（A对），可与底物竞争酶的底物结合部位（B对），进而起到抑制作用。当抑制剂存在时Km值变大（D对）、Vmax不变。抑制剂与酶非共价结合（E对），这种结合是可逆的，因此增加底物的浓度可以减弱竞争性抑制作用，当底物浓度远远大于抑制剂浓度时，抑制剂的抑制作用几乎为零，因此可以通过增加底物浓度的方式达到最大反应速度（C错，为本题正确答案）。